成年病人右耳慢性中耳炎十几年，近来发烧、呕吐升伴有剧烈头痛，颅腔CT检查拍片诊断为右颞叶脑脓肿，考虑由慢性中耳炎引起，叫脓肿破坏何结构造成右颞叶脑脓肿
A. 鼓室内侧壁
B. 鼓室外侧壁
C. 鼓室前壁
D. 鼓室后壁
E. 鼓室上壁

正确答案：E。鼓室上壁

解析：颅腔CT检查拍片诊断为右颞叶脑脓肿，表示发生了颅内感染，上壁分隔鼓室与颅中窝，中耳疾患时可侵犯上壁，引起耳源性颅内并发症（E对）。